根据《中药品种保护条例》，对特定疾病有显著疗效的中药属于
A. 四级保护品种
B. 三级保护品种
C. 一级保护品种
D. 二级保护品种

正确答案：D。二级保护品种

解析：本题考查中药保护品种的等级划分。根据《中药品种保护条例》，对特定疾病有显著疗效的中药属于二级保护品种（D对）。对受保护的中药品种分为一级和二级（AB错）进行管理。（1）申请中药一级保护品种（C错）应具备的条件：符合下列条件之一的中药品种，可以申请一级保护。①对特定疾病有特殊疗效的；②相当于国家一级保护野生药材物种的人工制成品；③用于预防和治疗特殊疾病的。申请中药二级保护品种应具备的条件：符合下列条件之一的中药品种，可以申请二级保护。①符合上述一级保护的品种或者已经解除一级保护的品种；②对特定疾病有显著疗效的；③从天然药物中提取的有效物质及特殊制剂。